客观地反映某一时点的疾病分布以及人们的某些特征与疾病之间的联系，这样的研究为
A. 描述性研究
B. 病例对照研究
C. 队列研究
D. 流行病学实验研究
E. 分析性研究

正确答案：A。描述性研究